女性青春期生长发育突增期发生在
A. 月经初潮前3～4年
B. 月经初潮前1～2年
C. 月经初潮时
D. 月经初潮后1～2年
E. 月经初潮后3～4年

正确答案：B。月经初潮前1～2年